世界上第一个将安乐死合法化的国家是
A. 荷兰
B. 美国
C. 比利时
D. 丹麦
E. 澳大利亚

正确答案：A。荷兰

解析：荷兰是世界上第一个颁布安乐死法律的国家，比利时是第二个。掌握“安乐死与死亡伦理”知识点。